与硫酸亚铁同用可生成难溶性化合物的是
A. 各种白酒
B. 乳酪食品
C. 葡萄柚汁
D. 盐腌海鱼
E. 茶叶

正确答案：E。茶叶

解析：本题考查饮食对药物疗效的影响。与硫酸亚铁同用可生成难溶性化合物的是茶叶（E对）。茶叶中含有大量的鞣酸，鞣酸能与药中的多种金属离子结合而发生沉淀，从而影响药品的吸收。酒（A错）的主要成分为乙醇，能够扩张血管，刺激或抑制肝药酶代谢系统。乳酪食品（B错）中含有酪胺，酪胺可被单胺氧化酶代谢，如果同时服用单胺氧化酶抑制药，食物中的酪胺则难以代谢而积蓄，造成交感神经兴奋，发生严重高血压危象等严重中毒反应，甚至死亡。葡萄柚汁（C错）主要影响CYP3A4代谢，同时可抑制CYP3A4的活性。盐腌海鱼（D错）属于高蛋白食物，而异烟肼可干扰鱼类所含蛋白质的分解，使酪胺和组胺在人体内积聚，发生中毒。